必要氮损失不包括
A. 粪代谢氮
B. 尿内源氮
C. 皮肤中排出的氮
D. 毛发及其他途径排出的氮
E. 消化的氮

正确答案：E。消化的氮